食品安全风险监测的目的不包括
A. 掌握我国食品安全状况
B. 及时发现食品安全隐患
C. 确定危害因素的分布和可能来源
D. 对食品中所有污染物的安全风险进行全面评估
E. 评价食品安全标准的执行情况与效果

正确答案：D。对食品中所有污染物的安全风险进行全面评估

解析：本题考查食品安全风险监测的目的。食品安全风险监测的目的包括：1.了解我国食品中主要污染物及有害因素的污染水平和变化趋势（D错，为本题正确答案），确定危害因素的分布和可能来源（C对），掌握我国食品安全状况（A对），及时发现食品安全隐患（B对）；2.评价食品生产经营企业的污染控制水平与食品安全标准的执行情况与效果（E对），为食品安全风险评估、风险预警、标准制（修）订和采取有针对性的监管措施提供科学依据；3.掌握我国食源性疾病的发病情况及流行趋势，提高食源性疾病的预警与控制能力。